关于纯化水的说法，错误的是
A. 纯化水可作为配制普通药物制剂的溶剂
B. 纯化水可作为中药注射剂的提取溶剂
C. 纯化水可作为中药滴眼剂的提取溶剂
D. 纯化水可作为注射用灭菌粉末的溶剂
E. 纯化水为饮用水经蒸馏、反渗透或其他适宜方法制得的制药用水

正确答案：D。纯化水可作为注射用灭菌粉末的溶剂

解析：本题考查纯化水。灭菌注射用水主要用于注射用灭菌粉末的溶剂（D错，为本题正确答案）或注射剂的稀释剂。纯化水为饮用水经蒸熘法、离子交换法、反渗透法或其他适宜方法制得的制药用水（E对），不含任何附加剂。纯化水可作为配制普通药物制剂用的溶剂（A对）或试验用水；中药注射剂、滴眼剂等灭菌制剂所用纯化水饮片的提取溶剂（BC对）；口服、外用制剂配制用溶剂或稀释剂；非灭菌制剂用器具的精洗用水。也可作非灭菌制剂所用饮片的提取溶剂。